病毒性肝炎肝细胞气球样变
A. 细胞水肿
B. 玻璃样变
C. 粘液变性
D. 淀粉样变
E. 脂肪沉积（脂肪变性）

正确答案：A。细胞水肿

解析：在病毒性肝炎中，肝细胞气球样变是肝细胞水肿（A对）的一种状态，是指细胞水肿发展到一定程度时，肝细胞肿胀呈圆球形，胞质几乎完全透明，状似气球。玻璃样变（P16）（B错）是指细胞内或间质中出现半透明状蛋白质蓄积的现象。粘液样变（P17）（C错）是指细胞间质内出现黏多糖（葡萄糖胺聚糖、透明质酸等）和蛋白质蓄积的现象。淀粉样变（P17）（D错）是指细胞间质内出现淀粉样蛋白质和黏多糖复合物蓄积的现象，具有淀粉染色的特征。脂肪沉积（脂肪变性）（P16）（E错）是指非脂肪细胞的胞质中出现甘油三酯蓄积的现象。